关于胆总管正确的描述是
A. 由肝左、右管汇合而成
B. 行于门静脉后方
C. 行于肝胃韧带内
D. 行于十二指肠降部的后方
E. 与胰管汇合后共同开口于十二指肠大乳头

正确答案：E。与胰管汇合后共同开口于十二指肠大乳头

解析：胆总管由肝左、右管汇合而成(A错)，行于门静脉前方(B错)，肝十二指肠韧带内(C错)，行于十二指肠上部后方和降部中份(D错)，与胰管汇合后共同开口于十二指肠大乳头(E对)。